石棉作业工人发生的肺部肿瘤特点中哪项是错误的
A. 石棉肺病人的肺癌的并发率很高
B. 从接触石棉到发现肺癌的潜隐期长（15～20年）
C. 致癌与接触剂量密切相关
D. 吸烟者与不吸烟者比较，其致癌率明显增高
E. 石棉所致肺癌的X线像多见于肺的上部

正确答案：E。石棉所致肺癌的X线像多见于肺的上部

解析：本题考查石棉肺所致肺癌表现。石棉接触者或石棉肺病人肺癌发生率显著增高（A对）。影响肺癌发生的因素是多方面的，如石棉粉尘接触量（C对）、石棉纤维类型、工种、吸烟习惯（D对）和肺内纤维化存在与否等。石棉诱发肺癌发病潜伏期一般是15～20年（B对）。石棉肺X线胸片早期多在两肺下区（E错，为本题正确答案）出现密集度较低的不规则形阴影，随病变进展而增粗增多，呈网状并逐渐扩展到两肺中、上肺区。